食物中特别容易致龋的食物是
A. 蔬菜
B. 牛奶
C. 花生
D. 饼干
E. 鸡蛋

正确答案：D。饼干

解析：本题考查龋病发生的食物因素。碳水化合物是细菌致龋的原料，含较多碳水化合物的食物特别容易致龋，这几种食物中饼干（D对）含有的碳水化合物最多，最易致龋病。蔬菜（A错）含有较多维生素，而维生素是生物的生长和代谢所必需的微量有机物，有利于牙齿的发育不会致龋。牛奶（B错）和鸡蛋（E错）中含有较多的蛋白质，而蛋白质对牙的影响，主要体现在牙萌出前的生长发育期，在此期间足够的蛋白质可促进牙齿的形态和结构的正常发育，使萌出后的牙齿抗龋力增加。花生（C错）含有较多脂肪，脂肪成分月桂酸、亚油酸与油酸能抑制牙面生物膜的形成，亚油酸和棕榈油酸能抑制变异链球菌产酸，因此花生能减少龋病的发生。